刺五加的功效有
A. 补气健脾
B. 益肾强腰
C. 生津止渴
D. 养心安神
E. 活血通络

正确答案：A、B、D、E。补气健脾；益肾强腰；养心安神；活血通络

解析：本题考查刺五加的功效。刺五加的功效有补气健脾（A对）、益肾强腰（B对）、养心安神（D对）、活血通络（E对）。刺五加【功效】补气健脾，益肾强腰，养心安神，活血通络。玉泉丸【功能】清热养阴，生津止渴（C错）。